在《中国药典》中，测定葡萄糖酸钙含量所使用的滴定液是
A. 乙二胺四醋酸二钠滴定液
B. 盐酸滴定液
C. 氢氧化钠滴定液
D. 碘滴定液
E. 硫酸铺滴定液

正确答案：A。乙二胺四醋酸二钠滴定液